不属于慢性肺源性心脏病的病因是
A. 肺动脉硬化
B. 肺动脉高压
C. 右心室扩大
D. 慢性阻塞性肺疾病
E. 肺动脉主干栓塞

正确答案：E。肺动脉主干栓塞

解析：慢性阻塞性肺疾病所引起的功能性因素（缺氧、高碳酸血症和呼吸性酸中毒），解剖性因素（反复发作的慢阻肺及支气管炎症、肺气肿压迫毛细血管网、肺血管重构、血栓形成）（A对），加上血液粘稠度增加和血容量增多，最终导致肺动脉高压（B对）。当肺动脉压持续增高超过右心室的代偿能力时，发生右心衰，右心室扩大（C对），最终导致慢性肺源性心脏病。慢阻肺（D对）是肺心病的常见病因。肺动脉栓塞是栓子堵塞肺动脉或其分支，引起肺循环呼吸功能障碍的临床和病理生理综合征。而肺动脉主干栓塞（E错，为本题正确答案）会导致急性肺心病。